下述哪项是正确的
A. HCV是DNA病毒
B. HCV为双链RNA病毒
C. HCV核苷酸序列变异性大
D. HCV只有一个基因型
E. HCV可以分为日本株与美国株，但同源性高达95%以上

正确答案：C。HCV核苷酸序列变异性大

解析：本题考查HCV的特性。HCV的基因组是单股正链RNA（AB错），HCV容易变异，其核苷酸序列变异大（C对），目前至少有6个基因型（D错），不同的HCV基因型有不同的地理分布特征，同源性未必接近（E错）。